关于牙外伤的防护，以下说法错误的是
A. 要提高学校师生、家长对牙外伤的认知水平
B. 加强学校牙外伤危害性的宣传
C. 提高自我保护意识
D. 运动中应积极采取防护措施
E. 牙外伤发生时去医院就诊即可，不必学习急救知识

正确答案：E。牙外伤发生时去医院就诊即可，不必学习急救知识

解析：预防牙外伤，首先要提高公众，特别是学校师生、家长对牙外伤的认知水平，增强防护意识。应加强学校的健康教育，加强牙外伤危害性的宣传。培养学生的防伤观念，提高自我保护意识。运动中应掌握动作要领，遵守一定的运动规则和规律，有条件的地方应积极采取防护措施。教育学生避免暴力行为，遵守交通规则，以减少牙外伤的发生。教师、家长和校医院医生应了解牙外伤急诊处理的基本常识，以利于牙外伤后的应急处理等。掌握“牙外伤的预防”知识点。